曾用过抗菌药物疑为伤寒的患者，最有诊断价值的实验室检查是
A. 粪培养
B. 血培养
C. 骨髓培养
D. 肥达反应
E. 血嗜酸性粒细胞计数

正确答案：C。骨髓培养

解析：伤寒骨髓培养：阳性率较血培养为高，可达90%。阳性率受病程及应用抗菌药的影响小，已开始抗菌治疗者仍可获阳性结果（C对）。